女，18岁。因不能自控地间断性反复的大量进食吃到难以忍受的腹胀为止，情绪易激惹，并有担心发胖的恐惧心理
A. 神经性发胖
B. 精神性贪食
C. 精神性躁狂
D. 神经性贪食
E. 神经性躁狂

正确答案：D。神经性贪食

解析：该患者因反复出现了大量进食吃到难以忍受的腹胀为止，情绪易激惹，并有担心发胖的恐惧心理为神经性贪食的临床表现（D对）。